男，21岁，上唇短，临床检查：上前牙唇侧牙龈边缘及龈乳头增生肥大，覆盖牙冠的1/3，质地较韧。最可能的诊断是
A. 增生性龈炎
B. 边缘性龈炎
C. 急性坏死性龈炎
D. 药物性牙龈增生
E. 牙龈纤维瘤病

正确答案：A。增生性龈炎

解析：本题考查牙龈炎的诊断。根据题目中的信息上前牙唇侧牙龈边缘及龈乳头增生肥大，覆盖牙冠的1/3，质地较韧，可诊断为增生性龈炎（A对）。急性坏死性溃疡性龈炎以龈乳头的坏死为其特征性损害，上覆有灰白色污秽的坏死物，龈缘如虫蚀状，坏死去出现灰白色假膜，易于擦去，龈乳头破坏后与龈缘成一直线，如刀切状，病损不波及附着龈，患处牙龈极易出血，疼痛明显，有典型的腐败性口臭，重症患者可有低热（C错）。药物增生性牙龈炎可表线为龈乳头呈球状、结节状，色呈淡粉红色，质地坚韧、略有弹性，有服药史（D错）。牙龈纤维瘤病龈缘、龈乳头和附着龈广泛增生，甚至达到膜龈联合，增生的牙龈颜色正常，组织坚韧，表面光滑，点彩明显，不易出血（E错）。